某女，65岁。因患风湿性关节炎多年，长期服用风湿骨痛胶囊。近日因外感头痛，拟服用正天丸。执业药师指出，此中成药联用不合理，原因是
A. 药物配伍联用存在证候禁忌
B. 药物中的成分存在“十八反”配伍禁忌
C. 药物中的相同成分存在“叠加”现象
D. 药物中的毒性成分存在“叠加”现象
E. 药物中的成分存在“十九畏”配伍禁忌

正确答案：D。药物中的毒性成分存在“叠加”现象

解析：本题考查的是中成药联用的配伍禁忌。因患风湿性关节炎多年，长期服用风湿骨痛胶囊。近日因外感头痛，拟服用正天丸。执业药师指出，此中成药联用不合理，原因是药物中的毒性成分存在“叠加”现象（D对）。风湿骨痛胶囊与正天丸均含有毒成分乌头类药物，应注意有毒成分成分的“叠加”。中成药联用的配伍禁忌：1.含“十八反”“十九畏”药味中成药的配伍禁忌（BE错）：现行版《中国药典》中有不宜同用药的规定，从不宜同用药的品种来看没有突破“十八反”和“十九畏”所含的品种。“十八反”“十九畏”中的药物，应属配伍禁忌，原则上是禁止应用。对于饮片处方，如果药味中含有“十八反”“十九畏”药物，那是比较容易发现的。但对于中成药，只有熟态中成药制剂的处方内容，才有可能发现此类的配伍禁忌。例如，治疗风寒湿痹证的大活络丸、尪痹冲剂、天麻丸、人参再造丸等均含有附子，而止咳化痰的川贝枇杷露、蛇胆川贝液、通宣理肺丸等分别含有川贝、半夏，依据配伍禁忌原则，若将上述两组合用，附子、乌头与川贝、半夏当属相反禁忌同用之列。利胆中成药利胆排石片、胆乐胶囊、胆宁片等都含有郁金，若与六应丸、苏合香丸、妙济丸、纯阳正气丸、紫雪散等含丁香（母丁香）的中成药同时使用，就要注意具“十九畏”药物的禁忌。临床常用中成药心通口服液、内消瘰疬丸中含有海藻，祛痰止咳颗粒含有甘遂，若与橘红痰咳颗粒、通宣理肺丸、镇咳宁胶囊等含甘草的中成药联用也属禁忌之列。2.含有毒药物中成药的联用：数种功效相似的中成药联用，在各自制剂的组成中，往往有一种或几种相同的药味。因此，联用将会增加某一味或几味药的剂量。如大活络丸与天麻丸合用，两者均含附子；朱砂安神丸与天王补心丸合用，两者均含朱砂，均会增加有毒药味的服用量，加大患者产生不良反应的危险性。故在使用时应考虑药物“增量”的因素。再如复方丹参滴丸和速效救心丸同属气滞血瘀型用药，其处方组成与功效基本相似，而且这一类的药物多数含有冰片，由于冰片药性寒凉，服用剂量过大易伤人脾胃，导致胃痛胃寒，故不可过量使用，在临床应用中使用其中一种即可。因此中成药之间的联合用药。尤其是几种含有毒成分或相同成分的中成药联合应用时，应注意有毒成分或相同成分的“叠加”，以免引起不良反应（C错）。3.不同功效药物联用的辨证论治和禁忌：如附子理中丸与牛黄解毒片联用，附子理中丸系温中散寒之剂，适用于脾胃虚寒所致的胃脘痛、呕吐、腹泻等；而牛黄解毒片性质寒凉，为清热解毒泻火之剂，适用于火热毒邪炽盛于内而上扰清窍者，可见不加分析地盲目将两者合用是不适宜的。再如，盲目将附子理中丸与黄连上清丸、金匮肾气丸与牛黄解毒片等合用，均属不注意证候的不合理用药（A错）。4.某些药物的相互作用问题：含麻黄的中成药忌与降血压的中成药如复方罗布麻片、降压片、珍菊降压片、牛黄降压丸等并用；也忌与扩张冠脉的中成药如速效救心丸、山海丹、活心丹、心宝丸、益心丸、滋心阴液、补心气液等联用。因麻黄中麻黄碱的化学结构与肾上腺素相似，能直接与肾上腺素受体结合，同时还能促使肾上腺素能神经末梢释放介质，从而使血管收缩、血压升高；另一方面，又能兴奋心脏，增强心肌收缩力，使心肌耗氧量增加。若同时并用，可产生拮抗作用。含朱砂较多的中成药，如磁朱丸、更衣丸、安宫牛黄丸等与含较多还原性溴离子或碘离子的中成药如消瘿五海丸、内消瘰疬丸等长期同服，在肠内会形成有刺激性的溴化汞或碘化汞，导致药源性肠炎、赤痢样大便。